关于药物粉体基本性质及其应用的说法，错误的是
A. 堆密度相差较大的药物粉体不易混合均匀
B. 难溶性药物经微粉化可因表面积增加而溶出加快
C. 药物粉体的堆密度大小对压片过程没有影响
D. 孔隙率大的药物粉本可压性差，压片时易产生松片
E. 休止角小的药物粉体流动性好，分剂量填充重量差异小

正确答案：C。药物粉体的堆密度大小对压片过程没有影响

解析：本题考查的是药物粉体基本性质及应用。关于药物粉体基本性质及其应用的说法，错误的是药物粉体的堆密度大小对压片过程没有影响（C错，为本题正确答案）。堆密度大的疏松颗粒或粉末，由于在压制过程中其中的空气难以完全释放出来，容易造成松片或裂片。通常细小、粒度分布均匀的粒子具有较大的比表面积，压片时的可压性好，压制成的片剂硬度大，重量差异小。反之，粗大、粒度分布不均匀的粒子（A对），会导致颗粒充填不均匀，片重差异大，而且使压片机的冲头压力分布不均，片剂硬度差，容易产生裂片（D对）。微粉化技术可减小粒径，提高药物的溶解度（B对）。休止角越小，说明摩擦力越小，流动性越好（E对）。